下列哪项不是高血压病的营养防治内容
A. 限制钠盐摄入量
B. 增加钾、钙、镁的摄入量
C. 减少膳食蛋白摄入量
D. 限制饮酒
E. 克服不良饮食习惯

正确答案：C。减少膳食蛋白摄入量